精神药品的经营单位和医疗单位应当
A. 建立精神药品收支账目
B. 按月盘点，账物相符
C. 按季度盘点，账物相符
D. 年度盘点，账物相符
E. 处方留存一年备查

正确答案：A、C。建立精神药品收支账目；按季度盘点，账物相符

解析：本题考查精神药品的储存。精神药品的经营单位和医疗单位应当建立精神药品收支账目（A对），按季度盘点，账物相符（C对）。管理定点生产企业、全国性批发企业和区域性批发企业、麻醉药品和第一类精神药品的使用单位，应当配备专人负责管理工作，并建立储存麻醉药品和第一类精神药品的专用账册。专用账册的保存期限应当自药品有效期期满之日起不少于5年。麻醉药品和第一类精神药品入出库实行双人核查制度，药品入库须双人验收，出库须双人复核，做到账、物相符。